断面纤维性，类白色或微红色，有一明显内皮层环纹，并可见多数棕色油点散在的中药材是
A. 半夏
B. 山药
C. 郁金
D. 百部
E. 石菖蒲

正确答案：E。石菖蒲